不是Ⅰ型子宫内膜癌的高危因素
A. 高血压
B. 糖尿病
C. 肥胖
D. 多产
E. 绝经延迟

正确答案：D。多产

解析：Ⅰ型子宫内膜癌多见，均为子宫内膜样癌，患者较年轻，常伴有肥胖（C对）、高血压（A对）、糖尿病（B对）、不孕或不育及绝经延迟（E对），或伴有无排卵性疾病、功能性卵巢肿瘤、长期服用单一雌激素或他莫昔芬等病史，肿瘤分化较好，雌、孕激素受体阳性率高，预后好（D错，为本题正确答案）。